糖尿病植物神经病变可引起
A. 窦性心动过缓
B. 室性早搏
C. 房室传导阻滞
D. 体位性低血压
E. 房颤

正确答案：D。体位性低血压

解析：糖尿病的植物神经（自主神经）病变时，多影响胃肠、心血管、泌尿生殖系统等。临床表现为胃排空延迟（胃轻瘫）、腹泻（饭后或午夜）、便秘等；休息时出现心动过速、直立性低血压（D对）、寂静性心肌缺血、QT间期延长等，严重者可发生心脏性猝死（ABCE错）。